我国《生活饮用水卫生监督管理办法》规定下列哪项涉及水产品须经卫健委审批方准投入生产、销售、使用
A. 与饮用水接触的防护涂料
B. 水质处理器
C. 与饮水接触的新材料和化学物质
D. 除垢剂
E. 以上都是

正确答案：E。以上都是

解析：本题考查须经卫健委审批方准投入生产、销售、使用的涉水产品。《生活饮用水卫生监督管理办法》规定：“涉及饮用水卫生安全的产品，必须进行卫生安全性评价。”其中由国家卫生计生委审批的产品：①与饮用水接触的防护涂料；②水质处理器；③与饮用水接触的新材料和化学物质；④涉及饮用水卫生安全的各类进口产品。由省级卫生计生部门审批的产品：①与饮用水接触的连接止水材料、塑料及有机合成管材、管件，各类饮水机；②水处理剂；③除垢剂。未经审批的不得生产、销售和使用（E对ABCD错）。